男，30岁，渔民。3周来高热，疲乏不适，腹胀，食欲减退，应用抗生素后发热逐渐消退，症状好转。今天下午突感腹部剧痛，面色苍白，随后高热、呕吐来诊。查体：T39℃，全腹肌紧张明显，压痛及反跳痛阳性。血白细胞12.5x10⁹/L，中性粒细胞84%，淋巴细胞16%。诊断为腹膜炎收外科急诊手术。可能性最大的诊断是
A. 肝炎并发原发性腹膜炎
B. 阿米巴痢疾并发肠穿孔
C. 伤寒并发肠穿孔
D. 急性血吸虫病并发腹膜炎
E. 急性阑尾炎穿孔

正确答案：C。伤寒并发肠穿孔